关于抗前列腺增生药物药理作用和临床应用的说法，正确的有
A. α₁受体阻滞剂坦洛新不能减小前列腺的体积，也不影响血清前列腺特异抗原（PSA）的水平
B. α₁受体阻滞剂特拉唑嗪不良反应有直立性低血压
C. 5α-还原酶抑制剂非那雄胺可以缩小前列腺的体积
D. 5α-还原酶抑制剂非那雄胺通常服药6个月后才能获得最大疗效
E. 5α-还原酶抑制剂非那雄胺可导致性欲减退，勃起功能障碍

正确答案：A、B、C、D、E。α₁受体阻滞剂坦洛新不能减小前列腺的体积，也不影响血清前列腺特异抗原（PSA）的水平；α₁受体阻滞剂特拉唑嗪不良反应有直立性低血压；5α-还原酶抑制剂非那雄胺可以缩小前列腺的体积；5α-还原酶抑制剂非那雄胺通常服药6个月后才能获得最大疗效；5α-还原酶抑制剂非那雄胺可导致性欲减退，勃起功能障碍

解析：本题考查抗前列腺增生药物药理作用和临床应用。α₁受体阻断药通过阻滞α₁受体，使前列腺平滑肌松弛，尿道闭合压降低，达到缓解膀胱出口梗阻的动力性因素。α₁受体阻断药不能减小前列腺体积，也不影响血清前列腺特异抗原（PSA）的水平（A对）。α₁受体阻断药不良反应为直立性低血压（B对）。临床上应用5α-还原酶抑制剂（如非那雄胺），可以缩小前列腺体积（C对），对膀胱颈和平滑肌没有影响。5α-还原酶抑制剂一般需要用药治疗6～12个月才能获得最大疗效（D对）。5α-还原酶抑制剂非那雄胺可导致性欲减退，勃起功能障碍（E对）。